对放射治疗不敏感的肿瘤是
A. 恶性淋巴瘤
B. 鳞状细胞癌
C. 基底细胞癌
D. 骨肉瘤
E. 鼻咽癌

正确答案：D。骨肉瘤

解析：对放射线不敏感的肿瘤有：骨肉瘤、纤维肉瘤、肌肉瘤（胚胎性横纹肌肉瘤除外）、腺癌、脂肪肉瘤、恶性黑色素瘤等。掌握“恶性淋巴瘤”知识点。